男，18岁。右大腿下端肿胀，疼痛伴消瘦乏力2个月。查体：右膝上肿胀，皮肤静脉怒张。X线片见右股骨下端骨质破坏，可见Codman三角。首先考虑的诊断是：
A. 骨结核
B. 骨肉瘤
C. 骨软骨瘤
D. 骨巨细胞瘤
E. 慢性骨髓炎

正确答案：B。骨肉瘤

解析：青少年男性患者，右大腿下端肿胀、疼痛、皮肤静脉怒张、伴消瘦乏力（骨肉瘤常见表现），X线片见右股骨下端骨质破坏，可见Codman三角（骨肉瘤典型影像学表现），结合患者症状、体征和影像学表现，首先考虑的诊断是右股骨下端骨肉瘤（B对）。骨结核（A错）多见于脊柱，常有低热盗汗等结核中毒症状，X线可见骨质破坏和椎间隙狭窄。骨软骨瘤（C错）可长期无症状，X线表现为干骺端的外生性骨性突起。骨巨细胞瘤（D错）X线片特征性表现为骨端偏心性、溶骨性、囊性破坏而无骨膜反应，病灶呈肥皂泡样改变。慢性骨髓炎（E错）的典型患者可有皮肤窦道形成，伴死骨排除，X线表现为虫蛀状骨破坏与骨质稀松，并逐渐出现硬化区。